缓冲固定酸的主要缓冲对是
A. 磷酸盐缓冲系统
B. 碳酸氢盐缓冲系统
C. 血红蛋白缓冲系统
D. 血浆蛋白缓冲系统
E. 氧合血红蛋白缓冲系统

正确答案：B。碳酸氢盐缓冲系统

解析：缓冲固定酸的主要缓冲对是碳酸氢盐缓冲系统（B对），体内挥发酸的缓冲主要靠非碳酸氢盐缓冲系统。